以下哪项不是感受器的一般生理特性
A. 对适宜刺激最敏感
B. 有换能作用
C. 编码功能
D. 适应现象
E. 处理编码

正确答案：E。处理编码